非经典抗精神病药利培酮的组成是
A. 氯氮平
B. 氯噻平
C. 齐拉西酮
D. 帕利哌酮
E. 阿莫沙平

正确答案：D。帕利哌酮

解析：本题考查利培酮的活性代谢产物。利培酮是运用骈合原理设计的非经典抗精神病药物，口服吸收完全，在肝脏受CYP2D6酶催化，生成帕利哌酮（D对）和N-去烃基衍生物，均具有抗精神病活性。骈合原理主要是指将两种具有生物活性的化合物的通过共价键连接起来，进入体内分解成两个有效成分，以减小两种药物的毒副作用。齐拉西酮（C错）也是根据骈合原理而设计的非经典抗精神病药，但非利培酮的组成；氯氮平（A错）的主要代谢产物为去甲基氯氮平和氯氮平-N-氧化物；氯噻平（B错）是将吩噻嗪分子的硫原子以甲亚胺基取代得到的；阿莫沙平（E错）是洛沙平的脱甲基代谢物，通过抑制脑内突触前膜对去甲肾上腺素的再摄取产生较强的抗抑郁作用。